患者，男，75岁，肺癌晚期，骨转移，口服吗啡控释片止痛，近日因疼痛加剧，增加吗啡剂量后出现便秘。不宜选用的药物是
A. 比沙可啶肠溶片
B. 多潘立酮片
C. 开塞露
D. 聚乙二醇4000散
E. 乳果糖口服溶液

正确答案：A。比沙可啶肠溶片

解析：本题考查药物相互作用。使用阿片类止痛剂（如吗啡、哌替啶）的癌症患者，对比沙可啶肠溶片（A错，为本题正确答案）的耐受性差，可能会造成腹痛、腹泻和大便失禁，因此两者不宜合用。